治疗肝气犯胃的胃痛，除主穴外，还应选取的配穴是
A. 内庭、胃俞
B. 期门、太冲
C. 胃俞、脾俞
D. 膈俞、三阴交
E. 脾俞、关元

正确答案：B。期门、太冲

解析：胃痛的基本治法是和胃止痛，以足三里、中脘、内关为主穴，寒邪犯胃配胃俞、神阙；饮食伤胃配梁门、天枢；肝气犯胃配期门、太冲（B对）；气滞血瘀配膻中、膈俞；脾胃虚寒配神阙、胃俞、脾俞；肾阴不足配胃俞、三阴交。